可升高红细胞，用于肾性及非肾性贫血的药品是
A. 硫酸亚铁
B. 重组人血促素
C. 维生素B₁₂
D. 人血白蛋白
E. 非格司亭

正确答案：B。重组人血促素

解析：本题考查重组人促红素。重组人促红素（B对）可用于肾衰竭贫血、非肾性贫血及早产儿贫血等。